患者，女，21岁。形体消瘦，腹部隐痛，大便有虫节片排出，诊断为绦虫槟榔的用量是
A. 0.1g
B. 1g
C. 10g
D. 60g
E. 150g

正确答案：D。60g

解析：槟榔的用法用量为驱绦虫、姜片虫30～60g（D对）。